男，56岁，嗜酒。因近3个月疲乏无力、心悸、气促、全身水肿并逐渐加重而住院治疗。经强心、利尿、补充白蛋白、抗感染治疗1周后无效。医生考虑可能是由于缺乏某种营养索所致。该男子可能缺乏的营养素为
A. 维生素A
B. 维生素B₁
C. 维生素B₂
D. 维生素C
E. 维生素D

正确答案：B。维生素B₁